下列选项属于特殊转运的是
A. 主动转运
B. 简单扩散
C. 易化扩散
D. 膜动转运

正确答案：A、C。主动转运；易化扩散

解析：本题考查特殊转运。外源化学物通过生物膜的方式可分为被动转运、特殊转运和膜动转运三类。其中被动转运包括简单扩散（B错）和滤过；特殊转运包括主动转运（A对）和易化扩散（C对）；膜动转运（D错）主要包括胞吞作用和胞吐作用。